侵袭性牙周炎下颌第一磨牙特有的骨吸收形式是
A. 水平型骨吸收
B. 垂直型骨吸收
C. 凹坑状吸收
D. 反波浪形骨吸收
E. 弧形骨吸收

正确答案：E。弧形骨吸收

解析：局限型侵袭性牙周炎的特征是“局限于第一恒磨牙或切牙的邻面有附着丧失，至少波及两个恒牙，其中一个为第一磨牙。其他患牙（非第一磨牙和切牙）不超过两个”。简而言之，典型的患牙局限于第一恒磨牙和上下切牙，多为左右对称。但早期的患者不一定波及所有的切牙和第一磨牙。X线片所见第一磨牙的邻面有垂直型骨吸收，若近远中均有垂直型骨吸收则形成典型的“弧形吸收”，在切牙区多为水平型骨吸收。掌握“慢性牙周炎的病因，表现诊断及预后”知识点。